某病人认为幼年时某次呕吐，实际上就是有人在食物中放毒，所以现在有病，是他们还没有放弃迫害，属于
A. 近事遗忘
B. 远事遗忘
C. 错构
D. 妄想性回忆
E. 虚构

正确答案：D。妄想性回忆

解析：该病例患者回忆起幼年呕吐就遭人投毒，而现在有病，是他们还没有放弃迫害的缘故（对既往经历做出某些妄想的解释，且内容固定，坚信不疑），即为妄想性回忆（D对）。错构指患者对过去所历过的事件所发生的地点、情节、时间上出现错误的回忆，并坚信不疑（C错）。虚构指患者以想象的、未曾亲身经历的事件来填补记忆的缺损（E错）。